男，52岁。颈肩痛3个月，并向左上肢放射。左上肢肌力下降，手指动作不灵活。颈椎棘突间有压痛，左手拇指感觉减弱。上肢牵拉试验阳性，压头试验阳性。最可能的颈椎病类型是：
A. 脊髓型
B. 神经根型
C. 混合型
D. 椎动脉型
E. 交感神经型

正确答案：B。神经根型

解析：患者颈肩痛，并向左上肢放射（神经根型颈椎病早期表现），左上肢肌力下降、手指动作不灵活、左手拇指感觉减弱（神经根型颈椎病典型表现），上肢牵拉试验阳性、压头试验阳性（神经根型颈椎病主要体征），故该患者最可能的颈椎病类型为神经根型颈椎病（B对）。脊髓型颈椎病（A错）常表现为上肢或下肢麻木无力、僵硬、双足踩棉花感，足尖不能离地，触觉障碍、束胸感，双手精细动作笨拙，不能用筷子进食，肌力减退，四肢腱反射活跃或亢进，Hoffmann征、髌阵挛、踝阵挛及Babinski征等阳性。椎动脉型颈椎病（D错）主要表现为突发性眩晕而猝倒、偏头痛、听力减退或耳聋、视力障碍等。交感神经型颈椎病（E错）主要表现为交感神经受刺激的症状，可为兴奋性也可为抑制性。混合型颈椎病（C错）多有两种或多种类型症状同时出现。